支配泪腺的副交感纤维来源于
A. 动眼神经
B. 三叉神经
C. 面神经
D. 舌咽神经
E. 迷走神经

正确答案：C。面神经

解析：支配泪腺的副交感纤维来源于面神经（C对）。动眼神经（A错）的副交感纤维支配瞳孔括约肌、睫状肌。三叉神经（B错）的特殊内脏运动纤维支配咀嚼肌。舌咽神经（D错）的一般内脏运动纤维支配腮腺分泌。迷走神经（E错）的一般内脏运动纤维支配胸腹腔脏器的平滑肌、心肌和腺体活动。